一侧皮质核束
A. 只支配对侧动眼神神经核
B. 只支配对侧动眼神经副核
C. 支配双侧面神经核
D. 支配对侧舌下神经核
E. 只支配对侧疑核

正确答案：D。支配对侧舌下神经核

解析：一侧皮质核束支配对侧舌下神经核（D对）。因为面神经核下部和舌下神经核只接受单侧（对侧）皮质核束支配，所以只接受一侧皮质核束的脑神经核为面神经核下部、舌下神经核。